乳前牙邻面浅龋及乳磨（牙合）面广泛性浅龋，1年内将被恒牙替换者采用的治疗方法是
A. 化学疗法
B. 再矿化法
C. 窝沟封闭法
D. 预防性充填法
E. 拔除法

正确答案：A。化学疗法

解析：本题考查药物治疗的适应证。前牙邻面浅龋及乳磨（牙合）面广泛性浅龋，1年内将被恒牙替换者符合乳牙药物治疗即化学疗法（A对）的适应证。药物治疗又称化学疗法是通过氟化物等化学药物涂布于不需要手术治疗的乳牙表面，以阻止龋病的进展，属于非手术龋病治疗方法。再矿化法（B错）是采用人工方法使脱矿釉质或牙骨质再次矿化，恢复其硬度，终止或消除早期龋，适用于光滑面早期龋，龋易感者等。窝沟封闭法（C错）适用于完全萌出尚未发生龋坏深窝沟恒牙。预防性充填法（D错）适用于深窝沟有可疑龋的乳牙或恒牙。该乳前牙尚有1年才能被替换，且龋损小对恒牙胚和乳牙几乎无影响不需拔除（E错），以防乳牙早失影响继承恒牙的萌出。